某医疗卫生机构已安装污染物排放在线监控装置，但是装置经常处于关闭状态，且逾期不改正。该机构可能受到的处罚是
A. 处5000元以上3万元以下的罚款
B. 处5000元以上1万元以下的罚款
C. 处1万以上3万元以下的罚款
D. 吊销执业许可证件
E. 依法追究刑事责任

正确答案：A。处5000元以上3万元以下的罚款